男性，6个月大。哭闹时，右侧腹股沟隆起肿块，平静时肿块可自行消失。最佳处理方法是
A. 绷带压住腹股沟深环，观察
B. 尽早施行疝囊高位结扎术
C. 施行加强前壁的疝修补术
D. 施行加强后壁的疝修补术
E. 施行无张力疝修补术

正确答案：A。绷带压住腹股沟深环，观察

解析：男性患儿，哭闹时，右侧腹股沟隆起肿块，平静时肿块可自行消失（提示腹股沟疝），应考虑为右侧腹股沟斜疝。该患儿未满一岁，因此最佳处理方法是绷带压住腹股沟深环，保守观察治疗（A对）。因为婴幼儿腹肌可随躯体生长逐渐强壮，疝有自行消失的可能。尽早施行疝囊高位结扎术（B错）主要用于一岁以上的幼儿和绞窄性疝的患者；施行加强前壁的疝修补术（C错）、施行加强后壁的疝修补术（D错）、施行无张力疝修补术（E错）为成人腹股沟疝的常用治疗方法，均不是该患儿的最佳治疗方法。